口腔癌的致病因素包括
A. 不良生活方式
B. 光辐射
C. 核辐射
D. 生物因素如细菌，病毒等
E. 以上全是

正确答案：E。以上全是

解析：口腔癌的危险因素：不良生活方式、环境因素、生物因素（口腔感染与局部刺激口腔卫生不良、尖锐牙尖和不良修复体的长期刺激，被认为是口腔癌发生的原因之一）。掌握“口腔癌的预防”知识点。